患者，女，2米高处跌落后2小时，右腰部着地，伤后腰痛且全程可见肉眼血尿，P90次/分，BP110/70mmHg，右腰部青紫压痛，腹部无压痛反跳痛。初期不适宜的治疗措施为
A. 维持水电解质平衡
B. 观察生命体征，监测血红蛋白
C. 应用抗生素预防感染
D. 镇静，止痛
E. 肾动脉造影，血管栓塞止血

正确答案：E。肾动脉造影，血管栓塞止血

解析：患者女，高处跌落、右腰部着地（直接暴力（撞击）），腰痛、全程肉眼血尿（肾外伤临床表现）右腰部青紫压痛（出血或尿外渗），结合病史、临床表现，考虑肾损伤。维持水电解质平衡（A错）、观察生命体征，监测血红蛋白（B错）、应用抗生素预防感染（C错）、镇静，止痛（D错）均为肾外伤的初期保守治疗。肾动脉造影，血管栓塞止血（E对）是持久性血尿且较严重者才选择的。